苷型酸催化水解的易难顺序是
A. N-苷＞O-苷＞S-苷＞C-苷
B. N-苷＞O-苷＞C-苷＞S-苷
C. N-苷＞C-苷＞S-苷＞O-苷
D. O-苷＞N-苷＞S-苷＞C-苷
E. O-苷＞N-苷＞C-苷＞S-苷

正确答案：A。N-苷＞O-苷＞S-苷＞C-苷

解析：本题考查的是苷酸水解的难易程度。苷型酸催化水解的易难顺序是N-苷＞O-苷＞S-苷＞C-苷（A对）。按苷键原子不同，酸水解的易难顺序为：N-苷＞O-苷＞S-苷＞C-苷。C上无未共享电子对，不能质子化，很难水解。而N碱度大，易接受质子，故最易水解。但当N原子处于嘧啶或酰胺位置时，也难于用无机酸水解。